重型颅脑损伤最常见的并发症是
A. 褥疮
B. 消化道出血
C. 角膜溃疡
D. 尿路感染
E. 肺炎

正确答案：E。肺炎

解析：重型颅脑损伤最常见的并发症是肺炎（E对），最常见的死因是脑疝。消化道出血（库欣溃疡）（B错）为重型颅脑损伤常见的致命性并发症。褥疮（A错）见于长期卧床的患者。角膜溃疡（C错）常由眼球异物、外伤后感染所致，不是颅脑损伤的并发症。颅脑损伤较少并发尿路感染（D错）。